下列各项为口角炎常见临床表现，除了
A. 皮肤、黏膜充血
B. 黏膜丘疹
C. 口角湿白
D. 口角皲裂
E. 口角糜烂

正确答案：B。黏膜丘疹

解析：口角炎临床表现有以下三种：①营养不良性口角炎：表现为单纯或者双侧口角湿白色，有糜烂或溃疡，有横的沟裂，严重者可向内侧黏膜或皮肤延伸，沟裂深浅不一，长短不一，疼痛不明显。②感染性口角炎：口角区充血、红肿，有血性或脓性分泌物渗出、层层叠起呈污秽状的血痂或脓痂，疼痛明显。③创伤性口角炎：为单侧性口角区损害，为长短不一的新鲜创口，裂口常有渗血、血痂。④接触性口角炎：接触变应原或毒物后迅速发作。口角区局部充血、水肿、糜烂、皲裂，渗出液明显增多，疼痛剧烈。掌握“口角炎”知识点。